L-羟丙基纤维素
A. 崩解剂
B. 黏合剂
C. 两者均可
D. 两者均不可

正确答案：A。崩解剂

解析：本题考查片剂的常用辅料。崩解剂系指促使片剂在胃肠液中迅速破裂成细小颗粒的辅料。常用的崩解剂（A对）有：干淀粉、羧甲基淀粉钠（CMS-Na）、低取代羟丙基纤维素、交联羧甲基纤维素钠（CCMC-Na）、交联聚维酮（PVPP）和泡腾崩解剂（碳酸氢钠和枸橼酸组成的混合物，也可以用柠檬酸、富马酸与碳酸钠、碳酸钾、碳酸氢钾）等。L-羟丙基纤维素不可用作黏合剂（BCD错）。